下列药物的含量测定方法为：维生素A
A. 三点校正的紫外分光光度法
B. 高效液相色谱法
C. 四氮唑比色法
D. 气相色谱法
E. 双相滴定法

正确答案：A。三点校正的紫外分光光度法